经肝肾双途径代谢清除的药物是
A. 左氧氟沙星
B. 莫西沙星
C. 克林霉素
D. 氯霉素
E. 卡泊芬净

正确答案：C。克林霉素